喹诺酮类药物与糖皮质激素联合应用，会导致增加的风险是
A. 消化道出血
B. 牙龈增生
C. 肌腱断裂
D. Q-T间期延长
E. 间质性肺炎

正确答案：C。肌腱断裂

解析：本题考查喹诺酮类药物典型不良反应与禁忌。喹诺酮类药物与糖皮质激素联合应用，会导致肌腱断裂（C对）的风险增加。